关于气雾剂的叙述，正确的有
A. 气雾剂可在呼吸道、皮肤或其它腔道起局部作用或全身作用
B. 气雾剂可采用定量阀门准确控制剂量
C. 气雾剂喷出的粒子愈细愈好
D. 气雾剂按相组成分为单相、二相和三相气雾剂
E. 气雾剂可以直接到达作用部位，奏效快

正确答案：A、B、E。气雾剂可在呼吸道、皮肤或其它腔道起局部作用或全身作用；气雾剂可采用定量阀门准确控制剂量；气雾剂可以直接到达作用部位，奏效快

解析：本题考查气雾剂。气雾剂可在呼吸道、皮肤或其它腔道起局部作用或全身作用（A对）；可采用定量阀门准确控制剂量（B对）；可以直接到达作用部位，奏效快（E对）；气雾剂喷出的粒子到达作用部位，微粒必须是均匀的而不是越细越好（C错）；气雾剂按处方组成分类，气雾剂可分为二相气雾剂和三相气雾剂（D错）。